解热且具有抑制血小板聚集作用，增加出血危险的是
A. 布洛芬
B. 对乙酰氨基酚
C. 阿司匹林
D. 吲哚美辛
E. 贝诺酯

正确答案：C。阿司匹林

解析：本题考查阿司匹林的不良反应。阿司匹林（C对）能够抑制COX2，抑制炎症介质的形成，减少炎症部位肿痛症状；抑制血小板环氧酶乙酰化，抑制血小板聚集。布洛芬（A错）、对乙酰氨基酚（B错）、吲哚美辛（D错）、贝诺酯（E错）均属于NSAIDs，具有解热镇痛作用，但不能抑制血小板聚集。